真虚假实证腹满的临床表现是
A. 腹满且胀拒按
B. 腹满按之痛甚
C. 腹虽胀满而有时缓解
D. 腹满得泻反快
E. 腹胀满不能食

正确答案：C。腹虽胀满而有时缓解

解析：真虚假实证其疾病的本质为虚证，但会出现某些实证的表现，所以真虚假实证腹满的临床表现是腹虽胀满而有时缓解，不像实证常满不减（C对）。腹痛拒按，按之痛甚，并伴有腹部硬满者，多为实证，如饮食积滞、胃肠积热之阳明腑实、瘀血肿块等（AB错）。太阴病证表现为腹满而吐，食不下，口不渴，自利，时腹自痛，四肢欠温，脉沉缓而弱（D错）。小儿腹大，面黄肌瘦，不欲进食，发结如穗，多为疳积（E错）。